可摘局部义齿初戴时就位困难的处理方法是
A. 用力将义齿戴入
B. 缓冲基托组织面
C. 缓冲卡环体
D. 调整（牙合）支托
E. 确定阻碍部位后逐步调改、缓冲

正确答案：E。确定阻碍部位后逐步调改、缓冲

解析：戴义齿时若就位困难，应找出原因，加以修改。如卡环臂过紧，多因制作卡环时磨损了模型所致，可稍使之放松；如因卡环体坚硬部分进入倒凹区，不能磨改卡环，只能磨改与卡环体相应部位的基牙；若基托进入倒凹区，致使义齿不能戴入，可用红蓝咬合纸进行检查，确定出阻碍部位。取出义齿，用金刚钻或小轮状石磨除阻碍处的着色点，即可磨去进入倒凹区的塑料基托。经反复戴入和调改，直到完全就位。但每次调改不能过多，以免使义齿与基牙间形成间隙，而造成嵌塞食物。掌握“局部义齿修复后出现的问题及处理”知识点。